风寒感冒的主要病症有
A. 发热
B. 恶寒
C. 鼻流清涕
D. 无汗头痛
E. 肢体酸痛

正确答案：A、B、C、D、E。发热；恶寒；鼻流清涕；无汗头痛；肢体酸痛

解析：本题考查的是感冒的辨证论治。风寒感冒的主要病症有恶寒（A对）、发热（B对）、鼻流清涕（C对）、无汗头痛（D对）与肢体酸痛（E对）。风寒感冒：【症状】恶寒重，发热轻，无汗头痛，肢体酸痛，或鼻塞声重，或鼻痒喷嚏，流涕清稀，咽痒，咳嗽，咳痰稀白。舌苔薄白，脉浮紧。